关于上颌第二磨牙形态描述正确的是
A. （牙合）面斜嵴较上颌第一磨牙明显
B. 近中舌尖与远中舌尖大小相近
C. 近中颊轴嵴较远中颊轴嵴突出
D. 颊舌根间分叉度较大
E. 牙根偏向近中

正确答案：C。近中颊轴嵴较远中颊轴嵴突出

解析：本题考查上颌第二磨牙的形态特点。近中颊轴嵴较远中颊轴嵴突出（C对）。上颌第二磨牙牙冠颊面自近中向远中向舌侧的倾斜度大于上颌第一磨牙，远中颊尖明显缩小。上颌第二磨牙近远中舌尖大小不相近（B错），近中舌尖较大，远中舌尖较小。牙合面斜嵴不如上颌第一磨牙明显（A错），远中沟比上颌第一磨牙明显。牙根数与上颌第一磨牙相同，颊舌根间分叉度较小（D错），牙根偏向远中（E错）。